人际传播可以通过下列方式进行但什么应除外
A. 语言
B. 广播
C. 手势
D. 表情
E. 戏曲

正确答案：B。广播